以下哪项不是磨损的病因
A. 牙齿组织结构不完善
B. 全身性疾病
C. 外力碰撞
D. 硬食习惯
E. 咬合负担过重

正确答案：C。外力碰撞

解析：牙齿磨损的原因有如下几点：牙齿组织结构不完善、咬合负担过重、硬食习惯、全身性疾病、咬紧牙或磨牙等不良习惯。而外力碰撞是牙齿急性损伤的原因。掌握“磨损”知识点。